女，62岁。反复咳嗽，痰中带血伴低热1月余。查体：气管向左移位，左肺可闻及细湿啰音。为明确诊断，首选的检查是
A. 结核抗体检测
B. 胸部X线片
C. 支气管镜
D. 痰结核分枝杆菌培养
E. 结核菌素试验

正确答案：B。胸部X线片

解析：该患者反复咳嗽、痰中带血伴低热1月，气管向左移位，左肺可闻及细湿啰音（肺结核渗出性病变范围较大或有干酪样坏死时，则有肺实变体征，可引起气管向患侧移动，可闻及支气管呼吸音及湿啰音），根据其临床表现和体征，考虑诊断为肺结核。肺结核的首选检查是胸部X线片（B对），可发现轻微的结核病变。结核抗体检查（A错）阳性表明体内存在结核抗体，有过结核杆菌感染，但并不能诊断为结核病。痰结核分枝杆菌培养（D错）灵敏度高，常作为结核病诊断的“金标准”，但由于结核分枝杆菌培养费时较长，一般为2～8周，因此不作为首选。纤维支气管镜检查（C错）常应用于支气管结核和淋巴结支气管瘘的诊断，对于肺内结核病灶不作为首选。结核菌素试验（E错）阳性表示有过结核分枝杆菌的感染，但并不能表示检出结核病，结核菌素试验对于儿童、青年以及未接种过卡介苗的结核病诊断有参考意义。